患者，女，29岁，孕25+6周，近日出现乏力、困倦、食欲不振、恶心等症状，化验结果为Hb71g/L，诊断为缺铁性贫血，予以蔗糖铁治疗。该药适宜的给药方式是
A. 口服每次5ml，一日3次
B. 先静脉注射负荷剂量，再静脉滴注余下剂量
C. 快速静脉注射
D. 先少量缓慢静滴，观察无过敏反应后再继续静脉滴注余下剂量
E. 恒速静脉滴注

正确答案：D。先少量缓慢静滴，观察无过敏反应后再继续静脉滴注余下剂量

解析：本题考查蔗糖铁给药方式。根据题干，该患者为孕妇，并且出现乏力、困倦、食欲不振、恶心等症状，需要快速补铁，给药方式如下：先少量缓慢静滴，观察无过敏反应后再继续静脉滴注余下剂量（D对）。蔗糖铁为抗贫血药，用于口服铁剂效果不好而需要静脉（A错）铁剂治疗的病人，在新病人第一次治疗前，应按照推荐的方法先给予一个小剂量进行测试，成人用1～2.5ml（20～50mg铁），体重＞14kg的儿童用1ml（20mg铁），体重<14kg的儿童用日剂量的一半（1.5mg/kg），应备有心肺复苏设备。如果在给药15分钟后未出现任何不良反应，继续给予余下的药液。